2岁6个月男婴，体重8.5kg，身高80cm，明显消瘦，喜哭吵，皮肤苍白，腹壁皮下脂肪0.3，冲脉，诊断为
A. Ⅰ度营养不良
B. Ⅱ度营养不良
C. Ⅲ度营养不良
D. 恶性度营养不良
E. 正常儿

正确答案：B。Ⅱ度营养不良

解析：患儿两岁6个月男婴，体重8.5kg，根据公式，1岁至青春前期体重（kg）=8+2×年龄，患儿正常体重应为12kg，患儿身高80cm，根据公式，身高（cm）=7×年龄+75，患儿正常身高应为89cm，Ⅱ度营养不良体重减低25%～40%，腹部皮褶厚度<0.4cm，故诊断为Ⅱ度营养不良（B对）。Ⅰ度营养不良体重减低15%～25%，腹部皮褶厚度为0.8cm～0.4cm。患儿腹壁皮下脂肪0.8cm（A错）。Ⅲ度体重减低>40%，腹部皮褶消失（C错）。恶性度营养不良初起病时常表现为精神差、呆木，不爱活动，食欲减退，体重不增或减轻，若此时发生感染或腹泻，则迅速出现恶性营养不良症状（D错）。